开展精神障碍诊断、治疗活动应当具备的条件说法有误的是
A. 有与从事精神障碍诊断、治疗相适应的主任医师
B. 有与从事精神障碍诊断、治疗相适应的护士
C. 有满足开展精神障碍诊断、治疗需要的设施和设备
D. 有完善的精神障碍诊断、治疗管理制度和质量监控制度
E. 从事精神障碍诊断、治疗的专科医疗机构还应当配备从事心理治疗的人员

正确答案：A。有与从事精神障碍诊断、治疗相适应的主任医师